根据病因及发病机制，贫血可分为
A. 红细胞生成减少、造血功能不良两种
B. 红细胞生成减少、造血功能不良及红细胞破坏过多三类
C. 红细胞生成减少、红细胞破坏过多及失血三类
D. 红细胞生成减少、溶血、失血、再障及缺铁等五类
E. 红细胞生成减少、红细胞过度破坏、失血及造血功能不良四类

正确答案：C。红细胞生成减少、红细胞破坏过多及失血三类

解析：根据病因及发病机制，贫血可分为红细胞生成减少性贫血、红细胞破坏过多性贫血及失血性贫血三类。掌握“贫血概论及缺铁性贫血”知识点。